药效受食物成分影响较大的药物是
A. 达比加群酯
B. 氯吡格雷
C. 尿激酶
D. 依诺肝素钠
E. 华法林

正确答案：E。华法林

解析：本题考查华法林。药效受食物成分影响较大的药物是华法林（E对）。达比加群酯（A错）是最前沿的新一代口服抗凝药物直接凝血酶抑制剂(DTIs），较少发生药物相互作用，无药物食物相互作用，无需常规进行凝血功能监测或剂量调整。氯吡格雷（B错）用于近期心肌梗死、近期缺血性卒中、非心源性栓塞性缺血性脑卒中或确诊外周动脉性疾病及急性冠脉综合征，非ST段抬高性急性冠脉综合征。尿激酶（C错）是一种溶栓药，临床用于深静脉血栓的溶栓治疗。依诺肝素钠（D错）用于预防静脉栓塞性疾病。